微孔膜包衣片的衣膜材料是
A. 聚乙二醇
B. 卡波姆
C. 微晶纤维素
D. 乙基纤维素
E. 硬脂酸

正确答案：D。乙基纤维素

解析：本题考查微孔膜包衣片。微孔膜包衣片通常是用胃肠道不溶的聚合物如醋酸纤维素、乙基纤维素（D对）、乙烯-醋酸乙烯共聚物、丙烯酸树脂等作为衣膜材料。聚乙二醇（A错）为微孔膜包衣的衣膜材料。卡波姆（B错）为亲水凝胶骨架材料。微晶纤维素（C错）为片剂常用的填充剂。硬脂酸（E错）为滴丸剂常用的脂溶性基质。